与药物剂量和本身药理作用无关、不可预测的药物不良反应是
A. 副作用
B. 首剂效应
C. 后遗效应
D. 特异质反应
E. 继发反应

正确答案：D。特异质反应

解析：本题考查药物的不良反应。与药物剂量和本身药理作用无关、不可预测的药物不良反应是特异质反应（D对）。特异质反应是指因先天性遗传异常，少数患者用药后发生与药物本身的药理作用无关的有害反应。副作用（A错）是药物固有的药理作用所产生的，由于药物作用的选择性低，药理效应涉及多个器官，当某一效应用于治疗目的时，其他效应就成为了副作用，所以副作用与本身药理作用有关。首剂效应（B错）是指首剂药物按常量给予引起不适的现象，这种药物需要用量从小剂量开始，逐渐加大到一般剂量。后遗效应（C错）是指在停药后，血药浓度已降至最小有效浓度以下时残存的药理效应。继发反应（E错）是继发于药物治疗作用之后的不良反应，是治疗剂量下治疗作用本身带来的间接结果，继发反应也是与药物本身药理作用有关的。